脑CT可见新月形高密度影的是
A. 硬膜下血肿
B. 硬膜外血肿
C. 蛛网膜下腔出血
D. 脑肿瘤
E. 硬膜下积液

正确答案：A。硬膜下血肿

解析：脑CT可见新月形高密度影是硬膜下血肿的典型影像学表现（A对）。硬膜外血肿（B错）CT扫描表现为颅骨内板与硬脑膜之间的双凸镜形或弓形高密度影。蛛网膜下腔出血（C错）CT扫描表现为脑沟与脑池密度增高。脑肿瘤（D错）CT扫描会显示低密度脑内病灶。硬膜下积液（E错）CT扫描表现为额颞顶部新月状低密度影。